可以引起耳蜗神经、肾损害的药物是
A. 加替沙星
B. 庆大霉素
C. 甲砜霉素
D. 多西环素
E. 林可霉素

正确答案：B。庆大霉素

解析：本题考查药物的不良反应。可以引起耳蜗神经、肾损害的药物是氨基糖苷类抗菌药物，庆大霉素（B对）属于氨基糖苷类。加替沙星（A错）可以引起跟腱断裂，血糖异常。甲砜霉素（C错）毒性可能比氯霉素小。多西环素（D错）属于四环素，可引起肠道菌群失调、肝毒性、牙齿黄染等。林可霉素（E错）大剂量静脉快速滴注可引起血压下降、心电图变化，甚至心跳、呼吸停止。